用亚硝酸钠滴定法测定盐酸普鲁卡因含量的依据是
A. 酯键的水解反应
B. 芳香环的硝基化反应
C. 芳香伯胺的重氮化反应
D. 叔氮原子的碱性
E. 盐酸的酸性

正确答案：C。芳香伯胺的重氮化反应

解析：本题考查亚硝酸钠滴定法。用亚硝酸钠滴定法测定盐酸普鲁卡因含量的依据是芳香伯胺的重氮化反应（C对）。芳香伯胺类药物，在盐酸存在下，能定量地与亚硝酸钠产生重氮化反应。依此，用已知浓度的亚硝酸钠滴定液滴定（用永停法指示终点），根据消耗的亚硝酸钠滴定液的浓度和毫升数，可计算出芳伯胺类药物的含量。